中毒性菌痢采用山莨菪碱治疗的主要作用是
A. 控制抽搐
B. 兴奋呼吸中枢
C. 解除微血管痉挛
D. 解除肠道痉挛
E. 抑制频繁的腹泻

正确答案：C。解除微血管痉挛

解析：山莨菪碱能阻断M胆碱受体，可用于解除微血管痉挛（C对），增加组织血液灌流量，改善微循环。由于山莨菪碱解除平滑肌痉挛作用和改善微循环作用明显，目前主要用于胃肠痉挛和感染中毒性休克治疗。山莨菪碱并不能控制抽搐（A错）、兴奋呼吸中枢（B错）、抑制频繁的腹泻（E错）；另外，中毒性菌痢常无肠道症状或较轻，所以没有肠道痉挛所以中毒性菌痢采用山莨菪碱不是为了解除肠道痉挛（D错）。